粉尘的分散度是指
A. 粉尘的分布距离
B. 粉尘的分布均匀程度
C. 粉尘粒径大小的数量或质量组成百分比
D. 粉尘的漂浮能力
E. 粉尘的沉降能力

正确答案：C。粉尘粒径大小的数量或质量组成百分比

解析：本题考查粉尘分散度的概念。分散度指粉尘颗粒大小的组成，以粉尘粒径大小的数量或质量（C对ABDE错）组成百分比来表示，前者称为粒子分散度，后者称为质量分散度。